正确的是
A. 子宫阔韧带由双层腹膜和平滑肌构成
B. 骶子宫韧带可限制子宫体向前移动
C. 维持子宫前倾前屈位的只有子宫圆韧带
D. 骶子宫韧带向后绕过直肠两侧，止于2~3骶椎前面的筋膜
E. 无

正确答案：D。骶子宫韧带向后绕过直肠两侧，止于2~3骶椎前面的筋膜

解析：子宫阔韧带由双层腹膜皱襞构成（A错），骶子宫韧带从子宫颈后面的上外侧，向后绕过直肠两侧， 止于2~3骶椎前面的筋膜（D对），于子宫圆韧带协同维持子宫前倾前屈位（BC错）。